X线平片脊柱旁双肾区可见圆形卵圆形致密影，密度高而均匀应考虑的疾病是
A. 肾结核
B. 肾结石
C. 胆囊结石
D. 肾癌
E. 肾囊肿

正确答案：B。肾结石

解析：平片检查，肾结石可为单侧或双侧性，位于肾窦部位，表现为圆形、卵圆形、桑椹状或鹿角状高密度影，可均匀一致，也可浓淡不均或分层（B对）。肾结核X线表现：平片可无异常发现，有时显示肾区内云絮状钙化，甚至全肾钙化（A错）。腹部平片是胆囊结石的检查方法之一。l5%胆囊结石可在腹部平片上显示，主要是混合性结石，它是由胆红素、胆固醇、钙盐等多种成分混合组成，因含钙盐较多，X线检查常可显影。其他类型则多不显影（C错）。肾癌平片上较大肾癌可致肾轮廓局限性外突，偶可发现肿瘤钙化，呈细点状或弧线状致密影（D错）。肾囊肿B超显示肾脏内无回声占位，囊肿壁光滑，无血流信号；必要时CT平扫显示肾脏的单发或多发囊性病变，囊肿壁光滑，囊肿与肾盂肾盏不相通，增强扫描无明显强化特征（E错）。